因疾病引起的疼痛和治疗中带来痛苦代价属于
A. 直接成本
B. 间接成本
C. 隐性成本
D. 固定成本
E. 机会成本

正确答案：C。隐性成本